若鼻腭管囊肿发生于骨内，则可表现为
A. 根尖周囊肿
B. 含牙囊肿
C. 鳃裂囊肿
D. 切牙管囊肿
E. 萌出囊肿

正确答案：D。切牙管囊肿

解析：鼻腭管囊肿若发生于骨内，则表现为切牙管囊肿。掌握“鼻腭管囊肿及鼻唇囊肿”知识点。